质子泵抑制剂（PPI）的作用特点有
A. 遇酸会快速分解，口服给药必须用肠溶剂型
B. 在体内均经过肝脏细胞色素P450酶代谢
C. 注射剂型中加入氢氧化钠是为了螯合金属离子，增强其稳定性
D. 对质子泵的抑制作用是可逆的
E. 单次抑酸作用可维持12小时以上

正确答案：A、B、E。遇酸会快速分解，口服给药必须用肠溶剂型；在体内均经过肝脏细胞色素P450酶代谢；单次抑酸作用可维持12小时以上

解析：本题考查质子泵抑制剂（PPI）的作用特点。质子泵抑制剂（PPI）的作用特点：（1）全身循环中的PPI经肝脏细胞色素P450酶代谢（B对）；（2）PPI对质子泵的抑制作用是不可逆的（D错），待新的质子泵生成后，才能恢复泌酸作用，故虽然PPI的体内半衰期只有1～2小时，但单次抑酸作用时间可维持12小时以上（E对）；（3）PPI遇酸会快速分解，口服必须采用肠溶剂型（A对）；PPI注射剂型在辅料中添加氢氧化钠，可确保稀释后的溶液pH在9～10之间，保证PPI不降解和变色（C错），有的PPI针剂在辅料中添加EDTA，整合那些能催化PPI降解的（微量）金属杂质。